下列各项，不属于清热药适用范围的是
A. 气分实热证
B. 阴盛格阳证
C. 血分实热证
D. 阴虚内热证
E. 湿热内蕴证

正确答案：B。阴盛格阳证

解析：清热药都是寒性药，不能用于治疗以真寒假热为实质的阴盛格阳（B错，为本题正确答案）。清热药适于气分实热证（A对）、血分实热证（C对）、阴虚内热证（D对）、湿热内蕴证（E对）。